喉室位于
A. 喉口外侧
B. 喉前庭内
C. 前庭襞的上方
D. 声襞的上方
E. 声襞的下方

正确答案：D。声襞的上方

解析：喉室位于声襞的上方（D对）。